下列疾病不属于乙类传染病的是
A. 风疹
B. 肺炭疽
C. 传染性非典型肺炎
D. 禽流感
E. 肺结核

正确答案：A。风疹

解析：肺炭疽（B对）、传染性非典型肺炎（C对）、禽流感（D对）、肺结核（E对）均属于乙类传染病。风疹属于丙类传染病（A错，为本题正确答案）。